宜用酸水提取，加碱调至碱性后可从水中沉淀析出的成分是
A. 香豆素类
B. 黄酮类
C. 生物碱类
D. 蒽醌类
E. 木脂素类

正确答案：C。生物碱类

解析：本题考查的是生物碱的溶解性。宜用酸水提取，加碱调至碱性后可从水中沉淀析出的成分是生物碱类（C对）。生物碱在酸水中成盐溶解，调碱性后又游离析出沉淀，可利用此性质提取分离生物碱。大多数生物碱在酸水或稀醇中与某些试剂反应生成难溶于水的络合物或复盐，这一反应称为生物碱沉淀反应。香豆素（A错）及其苷类先溶解于热稀苛性碱的水溶液中，酸化后沉淀析出，借以和杂质分离从而达到提取和精制的目的。黄酮类（B错）化合物溶于浓硫酸中生成的金属氧盐，常常表现出特殊的颜色，可用于鉴别。某些甲氧基黄酮溶于浓盐酸中显深黄色，且可与生物碱沉淀试剂生成沉淀。黄酮类化合物可与铅盐试剂反应，生成黄色至红色沉淀。蒽醌类（D错）化合物如具有α-酚羟基或邻二酚羟基，则可与Pb²⁺、Mg²⁺等金属离子形成络合物。与Pb²⁺形成的络合物在一定pH条件下能沉淀析出，与Mg²⁺形成的络合物具有一定的颜色，可用于鉴别。木脂素（E错）多数不挥发，少数如去甲二氢愈创酸能升华，游离木脂素偏亲脂性，难溶于水，能溶于苯、三氯甲烷、乙醚、乙醇等。与糖结合成苷者水溶性增大，并易被酶或酸水解。